邪正斗争及其盛衰变化，决定疾病的
A. 虚实
B. 表里
C. 上下
D. 内外
E. 寒热

正确答案：A。虚实

解析：本题考查的是邪正盛衰的病机。邪正斗争及其盛衰变化，决定疾病的虚实（A对）。邪正盛衰的病机，是指在疾病过程中，机体的抗病能力与致病邪气之间相互斗争中所发生的盛衰变化。这种斗争，不仅关系着疾病的发生，而且直接影响着疾病的发展和转归，同时也影响着病证的虚实变化。在疾病的发展过程中，邪正的消长盛衰变化决定病机、病证的虚实夹杂或转化。表里（B错）用以分辨疾病病位与病势的浅深。寒热（E错）用以分辨疾病的属性。